最常见的女性生殖细胞肿瘤的是
A. 卵黄囊瘤
B. 卵巢粘液性囊腺瘤
C. 卵巢黄素化囊肿
D. 卵巢颗粒细胞瘤
E. 畸胎瘤

正确答案：E。畸胎瘤

解析：卵巢生殖细胞肿瘤包括畸胎瘤，无性细胞瘤，卵黄囊瘤，其中，畸胎瘤为最常见的生殖细胞肿瘤（E对）。